某女，76岁，患脾虚乏力与肾虚腰膝酸软，治当补气健脾、益肾强腰，宜选用的药是
A. 绞股蓝
B. 刺五加
C. 白扁豆
D. 红景天
E. 西洋参

正确答案：B。刺五加

解析：本题考查的是刺五加的功效。患脾虚乏力与肾虚腰膝酸软，治当补气健脾、益肾强腰，宜选用的药是刺五加（B对）。刺五加：【功效】补气健脾，益肾强腰，养心安神，活血通络。绞股蓝（A错）：【功效】健脾益气，祛痰止咳，清热解毒。白扁豆（C错）：【功效】健脾化湿，消暑解毒。红景天（D错）：【功效】益气，平喘，活血通脉。西洋参（E错）：【功效】补气养阴，清热生津。